疫苗接种记录依法应保存的最低年限是
A. 3年
B. 5年
C. 2年
D. 1年
E. 4年

正确答案：B。5年

解析：疫苗接种记录依法应保存的最低年限是5年（B对）。